给药个体化的第一步是
A. 设计给药方案
B. 选好给药途径
C. 明确疾病诊断
D. 采集血样标本
E. 测定血药浓度

正确答案：C。明确疾病诊断

解析：本题考查个体化给药。给药个体化步骤：①根据诊断结果（C对）及患者的身体状况等具体因素，选择适合的药物及给药途径（B错）；②由临床药师跟临床医师一起拟订给药方案（A错）；③按初始方案用药；④随时观察临床效果，同时按一定时间采取血样标本（D错），测定血药浓度（E错），由血药浓度-时间的数据，求出患者的药动学参数。根据具体情况，可重复上述过程，反复调整给药方案。